医药商品出现质量问题待复验时应挂
A. 红色标记
B. 黄色标记
C. 绿色标记
D. 蓝色标记
E. 规定标记

正确答案：B。黄色标记

解析：本题考查药品储存要求。医药商品出现质量问题待复验时应挂黄色标记（B对）。在人工作业的库房储存药品，按质量状态实行色标管理：合格药品为绿色（C错），不合格药品为红色（A错），待确定药品为黄色。《中华人民共和国药品管理法》中关于药品包装的管理规定，第五十四条规定：麻醉药品、精神药品、医疗用毒性药品、放射性药品、外用药品和非处方药的表圈，必须印有规定标记（E错）。